评价临床试验效果的主要指标有
A. 发病率
B. 患病率
C. 有效率
D. 失访率
E. 病死率

正确答案：C。有效率